按照《执业药师资格制度暂行规定》，关于执业药师注册规定的说法正确的有
A. 执业药师注册证的有效期为五年
B. 申请注册者必须经执业单位同意
C. 执业药师变更执业范围，应办理变更注册手续
D. 执业药师应按照注册的执业类别、执业范围从事执业活动
E. 因健康原因不能从事执业药师业务的，应办理注销注册手续

正确答案：A、B、C、E。执业药师注册证的有效期为五年；申请注册者必须经执业单位同意；执业药师变更执业范围，应办理变更注册手续；因健康原因不能从事执业药师业务的，应办理注销注册手续

解析：本题考查的是执业药师注册管理。按照《执业药师资格制度暂行规定》，关于执业药师注册规定的说法正确的有执业药师注册证的有效期为五年（A对）；申请注册者必须经执业单位同意（B对）；执业药师变更执业范围，应办理变更注册手续（C对）；因健康原因不能从事执业药师业务的，应办理注销注册手续（E对）。执业药师注册管理：1.注册要求和条件：（1）注册要求：我国执业药师实行注册制度，国家药品监督管理局负责执业药师注册的政策制定和组织实施，指导全国执业药师注册管理工作。各省、自治区、直辖市药品监督管理部门负责本行政区域内的执业药师注册管理工作。取得执业药师职业资格的药学专业技术人员，经执业单位考核同意，通过全国执业药师注册管理信息系统向所在地注册管理机构申请注册。经批准注册者，由执业药师注册管理机构核发国家药监局统一样式的《执业药师注册证》，方可从事相应的执业活动。未经注册者，不得以执业药师身份执业。执业药师应当按照执业类别、执业单位、执业范围进行注册和执业（D错）。执业类别为药学类、中药学类、药学与中药学类；执业范围为药品生产、药品经营、药品使用以及其他需要提供药学服务的单位。机关、院校、科研单位、药品检验机构不属于规定的注册执业单位。执业药师注册执业范围为药品经营的，需在《执业药师注册证》上注明药品经营（批发）或药品经营（零售）；注册为零售连锁企业的，应在《执业药师注册证》上注明药品经营（零售），注册的执业单位应当明确到总部或门店，执业药师应当在其注册的执业单位执业。执业药师注册有效期为五年。需要延续的，应当在有效期届满三十日前，向所在地注册管理机构提出延续注册申请。（2）注册条件：申请注册的执业药师，必须具备以下条件：①取得《执业药师职业资格证书》；②遵纪守法，遵守执业药师职业道德，无不良信息记录；③身体健康，能坚持在执业药师岗位工作；④经执业单位考核同意。有下列情形之一的申请注册人员，不予注册：①不具备完全民事行为能力的；②因受刑事处罚，自刑罚执行完毕之日到申请注册之日不满2年的；③受过取消执业药师执业资格处分不满2年的；④国家规定不宜从事执业药师业务的其他情形的（主要包括：甲、乙类传染病传染期，精神病发病期等健康状况不适宜或者不能胜任执业药师业务工作的）。（3）香港、澳门永久性居民申请在内地执业的注册要求和条件：为进一步便利港澳台居民在内地（大陆）工作生活，推动药学专业技术人员的技术交流，12号文专门增加了针对港澳台居民申请执业药师职业资格的相关条款，明确港澳台居民申请国家执业药师职业资格考试、注册、继续教育、执业等活动，与内地（大陆）居民一样，参照相关规定具体办理。2.注册程序：（1）首次注册与延续注册：执业药师首次注册或延续注册，应填写《执业药师首次注册申请表》或《执业药师延续注册申请表》，并按要求准备相关材料，通过全国执业药师注册管理信息系统向所在地注册管理机构申请注册。注册机构在受理申请人的注册申请材料时，对于申请材料存在可以当场更正的错误，应允许申请人当场更正；对于申请材料不齐全或者不符合规定形式的，应一次告知申请人需要补正的全部内容。对于不予注册的，需注明原因及日期，并向申请人出具加盖本注册机构专用印章的书面通知。准予注册的，颁发《执业药师注册证》。执业药师注册有效期为五年。持证者须在有效期满三十日前向所在地注册管理机构提出延续注册申请。超过期限，不办理延续注册手续的人员，其《执业药师注册证》自动失效，并不能再以执业药师身份执业。办理延续注册时，同时变更执业单位的，须提交新执业单位合法开业证明。（2）变更注册与注销注册：执业药师变更执业单位、执业范围等应当及时办理变更注册手续。办理变更注册手续，应填写《执业药师变更注册申请表》，并按要求准备相关材料，交执业单位所在地省级药品监督管理部门（变更执业地区的申请材料应交新执业单位所在地省级药品监督管理部门）办理变更注册手续。对于以上资料，注册机构核对原件和复印件无误后，应当将原件返还申请人。注册机构应当自受理变更注册申请之日起7个工作日内作出准予变更注册的决定，收回原《执业药师注册证》，颁发新的《执业药师注册证》。变更执业范围、执业地区、执业单位，注册有效期不变。执业药师注册后如有下列情况之一的，应予以注销注册：①死亡或被宣告失踪的；②受刑事处罚的；③被吊销《执业药师职业资格证书》的；④受开除行政处分的；⑤因健康或其他原因不能从事执业药师业务的；⑥无正当理由不在岗执业超过半年以上者；⑦注册许可有效期届满未延续的。注销手续由执业药师本人或其所在单位向注册机构申请办理。